易并发脓胸、脓气胸的肺炎是
A. 呼吸道合胞病毒肺炎
B. 腺病毒肺炎
C. 金黄色葡萄球菌肺炎
D. 支原体肺炎
E. 衣原体肺炎

正确答案：C。金黄色葡萄球菌肺炎

解析：金黄色葡萄球菌肺炎（C对）易并发肺脓肿、脓胸、脓气胸、肺大疱、皮下气肿、纵隔气肿。呼吸道合胞病毒肺炎（A错）部分患儿可并发不同程度的肺气肿。少数腺病毒肺炎（B错）患儿并发渗出性胸膜炎，远期合并症有闭塞性细支气管炎、支气管扩张及其他慢性阻塞性肺疾病。支原体肺炎（D错）和衣原体肺炎（E错）都属于间质性肺炎，以肺外症状起病明显，有的可并发细菌性肺炎。